决定免疫球蛋白类别的结区是
A. 轻链可变区
B. 轻链恒定区
C. 重链恒定区
D. 铰链区
E. 重链可变区

正确答案：C。重链恒定区

解析：免疫球蛋白是介导体液免疫的重要效应分子，是B细胞接受抗原刺激后增值分化为浆细胞所产生的糖蛋白，基本结构分为重链和轻链。重链（H）根据抗原性的差异可将其分为5类：μ链、γ链、α链、δ链和ε链，不同的重链与轻链组成完整的抗体分子，分别称为IgM、IgG、IgA、IgD和IgE（ABD错）。重链可分为可变区和恒定区，可变区的抗原结合部位决定抗体的特异性（E错）（P29）；不同类别的抗体恒定区长度不一，决定免疫球蛋白的类别（C对）。